根管治疗后无明显临床症状或原有临床症状完全消失，即可进行
A. 根尖手术
B. 牙周洁治
C. 翻瓣术
D. 牙体缺损修复
E. 分根术

正确答案：D。牙体缺损修复

解析：根管治疗后无明显临床症状或原有临床症状完全消失，即可进行牙体缺损修复。掌握“疗效评定与牙体修复原则”知识点。